中西药合理联用可起到协同增效作用的是
A. 小青龙汤与抗组胺药联用
B. 含鞣质较多的中成药与铁剂联用
C. 五味子糖浆与磺胺类药联用
D. 逍遥散与催眠镇静类药联用
E. 含乙醇的中成药与硝酸甘油联用

正确答案：D。逍遥散与催眠镇静类药联用

解析：本题考查的是中西药合理联用的例举。中西药合理联用可起到协同增效作用的是逍遥散与催眠镇静类药联用（D对）。逍遥散或三黄泻心汤等与西药催眠镇静药联用，既可提高对失眠症的疗效，又可逐渐摆脱对西药的依赖性。小青龙汤、干姜汤、柴朴汤、柴胡桂枝汤等与抗组胺药联用（A错），可减少西药的用量和嗜睡、口渴等副作用。含鞣质较多的中药或中成药，不可与含金属离子的西药如钙剂、铁剂、氯化钴等合用（B错），因同服后可在回盲部结合，生成沉淀，致使机体难于吸收而降低药效。酸性较强的中药，如山楂、五味子、山茱萸、乌梅及中成药五味子糖浆、山楂冲剂等，不可与磺胺类药物联用（C错）。因磺胺类药物在酸性条件下不会加速乙酰化的形成，从而失去抗菌作用。含乙醇的中成药如各种药酒等，不可与硝酸甘油等扩张血管类西药同用（E错），因所含乙醇对交感神经和血管运动中枢有抑制作用，致使心肌收缩力减弱，血管扩张，从而与硝酸甘油的扩张血管作用产生协同作用，导致血压明显降低。